三段生殖试验主要包括以下内容
A. 一代繁殖试验、二代繁殖试验、三代繁殖试验
B. 一代繁殖试验、多代繁殖试验、致畸试验
C. 一般生殖毒性试验、围产期试验、致畸试验
D. 繁殖试验、围产期试验、致畸试验
E. 雄性生殖毒性试验、雌性生殖毒性试验、发育毒性试验

正确答案：C。一般生殖毒性试验、围产期试验、致畸试验